主要用于轻症2型糖尿病，尤其适用肥胖者的药物是
A. 阿卡波糖
B. 格列本脲
C. 格列齐特
D. 二甲双胍
E. 格列吡嗪

正确答案：D。二甲双胍

解析：本题考查二甲双胍的临床作用。二甲双胍（D对）用于单纯饮食控制不满意的2型糖尿病病人，尤其是肥胖和伴高胰岛素血症者，用本药不但有降血糖作用，还可能有减轻体重和高胰岛素血症的效果。阿卡波糖（A错）为葡萄糖苷酶抑制剂，适用于2型糖尿病及餐后血糖升高的患者。格列本脲（B错）、格列齐特（C错）和格列吡嗪（E错）均为磺酰脲类促胰岛素分泌剂，主要用于单用饮食控制无效的2型糖尿病和对胰岛素产生耐受的患者。